71岁男性，二年来无诱因逐渐出现行动缓慢，行走时上肢无摆动，前倾屈曲体态。双手有震颤，双侧肢体肌张力增高。无智能和感觉障碍，无锥体束损害征。选择最适当的治疗药物是
A. 安坦
B. 复方左旋多巴
C. 丙炔苯丙胺
D. 溴隐亭
E. 维生素

正确答案：B。复方左旋多巴

解析：患者老年男性，2年来无诱因逐渐出现行动缓慢，行走时上肢无摆动（肌张力增高），前倾屈曲体态。双手有震颤，双侧肢体肌张力增高。无智能和感觉障碍，无锥体束损害征，可诊断为帕金森。帕金森病患者治疗药物有抗胆碱能药、金刚烷胺、复方左旋多巴、多巴胺受体（DR）激动剂、单胺氧化酶B型（MAO-B）抑制剂、儿茶酚-氧位-甲基转移酶（COMT）抑制剂。≥65岁的老年患者首选复方左旋多巴（B对），必要时可加用溴隐亭（D错）等DR激动剂、丙炔苯丙胺（C错）等MAO-B抑制剂或COMT抑制剂。安坦（A错）又名盐酸苯海索，属于抗胆碱能药，因可造成智能障碍，尤其是对老年人影响比较明显，因此主要适用于震颤明显且年轻患者，老年患者慎用。维生素（E错）可与MAO-B抑制剂司来吉兰合用。